恶心呕吐，呃逆嗳气频作，其病机是
A. 痰浊上壅
B. 肺气上逆
C. 肝气上逆
D. 胃气上逆
E. 奔豚气逆

正确答案：D。胃气上逆

解析：气逆，多由情志所伤，或因饮食不当，或因外邪侵犯，或因痰浊壅阻所致，亦有因虚而气机上逆者。在肺，则肺失肃降，肺气上逆，发为咳逆上气（B错）。在胃，则胃失和降，胃气上逆，发为恶心、呕吐、嗳气、呃逆（D对）。在肝，则肝气上逆，发为头痛头胀，面红目赤，易怒等症（C错）。痰浊为病，随气上逆，尤易蒙蔽清窍，扰乱心神，使心神活动失常，出现头晕目眩、精神不振等症，或者痰浊上犯，与风、火相合，蒙蔽心窍，扰乱神明，以至出现神昏谵妄，或引起癫、狂、痫等疾病（A错）。奔豚气逆是临床以自觉气从少腹上冲胸咽为主要症状特征。 发作时，常伴见腹痛、胸闷气急、心悸、惊恐、烦躁不安，甚则抽搐、厥逆，或少腹有水气上冲至心下，或兼有乍寒乍热等（E错）。